下列药物入汤剂宜包煎的是
A. 茯苓
B. 滑石
C. 地肤子
D. 泽泻
E. 茵陈蒿

正确答案：B。滑石

解析：该题考查特殊煎药方法。包煎（P44）：主要指那些粘性强、粉末状及带有绒毛的药物…如蛤粉、滑石、青黛、旋覆花、车前子、蒲黄、及灶心土等”（B对ACDE错）。